下列关于甲状腺功能亢进症患者教育的说法，错误的是
A. 禁食富含碘的食物
B. 避免使用含碘药物
C. 妊娠伴甲状腺功能亢进症患者首选甲巯咪唑
D. 避免饮用咖啡等兴奋性饮料
E. 给予充足的热量、蛋白质和维生素

正确答案：C。妊娠伴甲状腺功能亢进症患者首选甲巯咪唑

解析：本题考查甲状腺功能亢进症患者教育。妊娠期妇女甲亢首选丙硫氧嘧啶（C错，为本题正确答案）。甲巯咪唑有新生儿皮肤缺损的致畸作用报道，妊娠期的甲亢孕妇首选丙硫氧嘧啶。甲状腺功能亢进症患者需避免碘摄入过多（A对），避免服用含碘的药物（B对）。甲亢患者应戒烟戒酒，禁用浓茶、咖啡等兴奋性饮料（D对）。甲亢患者需保证均衡膳食，给予充足热量、蛋白质、维生素（E对）等。